尿道损伤病人首选哪种检查方法
A. 导尿术
B. B超
C. 尿道造影
D. 尿道探子
E. 膀胱镜检查

正确答案：A。导尿术

解析：尿道损伤的病人首选导尿术（A对），目的是为了了解尿道的完整性和连续性，相对简便易行，对于后期亦有利于尿道的恢复及重建（P530）。B超（P524）（B错）是肾损伤等疾病的重要检查方法。尿道造影（C错）可显示尿道损伤部位及程度，但由于操作不易，通常不作为首选检查方法。尿道探子（P531）（D错）常用于治疗后尿道损伤的尿道会师复位术，而不用于尿道损伤的检查。膀胱镜检查（P570）（E错）是膀胱癌等疾病的重要检查方法。